胃阴虚，胃火盛者不宜服用的药是
A. 稻芽
B. 神曲
C. 麦芽
D. 鸡内金
E. 莱菔子

正确答案：B。神曲

解析：本题考查的是神曲的使用注意。胃阴虚，胃火盛者不宜服用的药是神曲（B对）。神曲：【使用注意】本品性温，故胃阴虚、胃火盛者不宜用。稻芽（A错）：既往有些地区习惯将稻芽称为谷芽。今将谷芽定为禾本科植物粟的成熟果实经发芽干燥的炮制加工品。其味甘性微温，功效与稻芽相似，食积兼寒者用之为宜。麦芽（C错）：【使用注意】本品能回乳，故妇女授乳期不宜大量服。鸡内金（D错）：【使用注意】本品消食化积力强，故脾虚无积滞者慎服。莱菔子（E错）：【使用注意】本品辛散耗气，故气虚及无食积、痰滞者慎服。